关于发病的基本原理下列哪项不正确
A. 正气不足是疾病发生的内在因素
B. 正气的强弱可决定发病的证候性质
C. 邪气是发病的重要条件
D. 邪气不在发病中起主导作用
E. 正盛邪实，多形成实证

正确答案：D。邪气不在发病中起主导作用

解析：发病是邪气与正气相互作用的结果，正气是决定发病的内在因素（A对），邪气是发病的重要条件（C对）。正气的强弱可决定发病的症候性质（B对），邪气侵入，若正气亢盛，奋起抗邪，邪正相搏剧烈，多表现为实证（E对）。